坐骨神经支配
A. 股四头肌
B. 缝匠肌
C. 半腱肌
D. 臀大肌
E. 臀中、小肌

正确答案：C。半腱肌

解析：股四头肌（A错）、缝匠肌（B错）由股神经支配。半腱肌（C对）由坐骨神经支配。臀大肌（D错）由臀下神经支配。臀中、小肌（E错）由臀上神经支配。